男性，45岁，酗酒后8小时出现中上腹疼痛，放射至两侧腰部，伴恶心呕吐。体检腹部有压痛、肌紧张及两侧腰腹部出现蓝棕色斑，血压75/55mmHg，脉搏110次/分，最可能的诊断是
A. 急性胆囊炎
B. 急性胃炎
C. 急性肠梗阻
D. 急性胰腺炎
E. 急性胆管炎

正确答案：D。急性胰腺炎

解析：中年男性患者，酗酒后（急性胰腺炎的常见病因）8小时出现中上腹疼痛，放射至两侧腰部，伴恶心、呕吐（急性胰腺炎的典型临床表现）。体查：腹部有压痛、肌紧张（腹膜刺激征），两侧腰腹部出现蓝棕色斑（Grey-Turner征），血压75／55mmHg，脉搏110次/分（坏死性胰腺炎可出现脉速、血压下降，乃至休克）。根据患者的病史及体查，最可能的诊断是急性胰腺炎（D对）。急性胆囊炎（P443）（A错）常表现为高脂饮食后突发右上腹阵发性绞痛，胆囊区压痛，Murphy征阳性，与患者临床表现不符。急性胃炎（B错）多表现为上腹痛、胀满、恶心、呕吐和食欲不振，部分患者可有剑突下压痛，无腹膜刺激征。急性肠梗阻（P358）（C错）多表现为腹痛、腹胀、呕吐、排气排便停止。急性胆管炎（E错）典型临床表现为Charcot三联症，即腹痛、寒颤高热、黄疸。